利福平可引起胃肠道反应除外的是
A. 恶心
B. 呕吐
C. 腹痛
D. 腹泻
E. 头痛

正确答案：E。头痛

解析：利福平可引起胃肠道反应：常见恶心、呕吐、腹痛、腹泻，一般不严重。掌握“异烟肼、利福平及乙胺丁醇”知识点。